提示结直肠癌诊断的最主要报警症状是
A. 腹胀
B. 腹痛
C. 腹泻
D. 便秘
E. 便血

正确答案：E。便血

解析：提示结直肠癌诊断的最主要报警症状是便血（E对）。腹胀（A错）多提示消化道功能障碍如：消化不良。腹痛（B错）不具有特异性，多种消化道、妇科、泌尿系疾病均可导致腹痛。腹泻（C错）多见于各类消化道功能失调及消化道感染性疾病。便秘（D错）多见于老人或消化道功能低下患者。